衡量药物进入体内后吸收速度快慢的参数是
A. K
B. Kₐ
C. Vd
D. t1/2
E. F

正确答案：B。Kₐ